腹膜内位器官
A. 是指器官的表面几乎都由腹膜被覆
B. 此类器官皆位于腹膜腔内
C. 属于此类的器官有盲肠、胆囊、阑尾、脾等
D. 以上说法全对
E. 以上说法全错

正确答案：A。是指器官的表面几乎都由腹膜被覆

解析：腹膜内位器官指器官表面几乎全被腹膜被覆的器官(A对)，腹膜腔为仅含少量浆液的潜在性腔隙(B错)，胆囊为腹膜间位器官(C错)。